女，26岁。妊娠33周，妊娠期糖尿病，通过调整饮食血糖水平控制良好、胎儿大小发育正常。下一步的处理是
A. 给予地塞米松
B. 每日监测血糖
C. 加用胰岛素治疗
D. 口服二甲双胍
E. 继续控制饮食

正确答案：E。继续控制饮食

解析：妊娠期糖尿病患者，通过调整饮食血糖水平控制良好、胎儿大小发育正常。只要继续控制饮食（E对），多数GDM患者能控制血糖在满意范围。无需每日监测血糖（B错）。经过饮食和运动管理，妊娠期血糖达不到标准时，应及时加用胰岛素（C错）或口服降糖药物（D错）进一步控制血糖。